属于酮体的物质是
A. 乙酰乙酸
B. 丙二酸
C. 丙酮酸
D. α-酮戊二酸
E. 草酰乙酸

正确答案：A。乙酰乙酸

解析：酮体包括乙酰乙酸（30%）（A对）、β-羟丁酸（70%）和丙酮（微量）。